女，27岁。劳累后心悸、气短5年，近一周间断咯血，无发热。查体：双颊紫红，口唇轻度发绀，颈静脉无怒张。两肺未闻及干湿啰音。心浊音界在胸骨左缘第三肋间向左扩大。心尖部局限性舒张期隆隆样杂音，第一心音亢进。肝脏不大，下肢无水肿。本病最易发生的心律失常是
A. 第一度房室传导阻滞
B. 心房颤动
C. 心室颤动
D. 室性期前收缩
E. 窦性心动过缓

正确答案：B。心房颤动